婴儿出生后各系统、器官的生长发育不平衡，呈先慢后快的是
A. 免疫系统
B. 神经系统
C. 生殖系统
D. 消化系统
E. 呼吸系统

正确答案：C。生殖系统

解析：在胎儿期，神经系统的发育领先于其他系统，新生儿神经细胞数目已于成人接近，出生后脑的发育主要为神经细胞的增大、树突的增加、髓鞘的形成与发育（约4岁完成），此后，神经系统呈水平发展，呈现出先快后慢（B错）的特点。免疫系统（A错）在儿童期迅速生长，青春期达高峰，以后逐渐降低；生殖系统（C对）早期发展缓慢，于青春期达高峰；消化系统（D错）、呼吸系统（E错）的生长发育趋势总体与体格生长相符。